在生活饮用水标准中，被IARC列为人类致癌物（1类）的物质是
A. 无机砷化合物
B. 无机汞化合物
C. 有机汞化合物
D. 镉化合物
E. 铅化合物

正确答案：A。无机砷化合物

解析：本题考查被IARC列为人类致癌物（Ⅰ类）的物质。饮用含高浓度砷的水对人有致癌作用，在生活饮用水标准中，无机砷化合物（A对BCDE错）已经被IARC列为人类致癌物（Ⅰ类）。